咳嗽喉痒，痰中带血，口干鼻燥，身热头痛，伴有少许恶寒，舌红少津，苔薄黄，脉数。其治法为
A. 疏风清肺，润燥止咳
B. 疏风散寒，宣肺止咳
C. 燥湿化痰，理气止咳
D. 清热化痰，肃肺止咳
E. 清肺泄热，化痰止咳

正确答案：A。疏风清肺，润燥止咳

解析：根据患者“咳嗽喉痒”辨病为咳嗽，伴有“痰中带血，口干鼻燥，身热头痛，伴有少许恶寒，舌红少津，苔薄黄，脉数”等症状，辨证为风燥伤肺证。风燥伤肺，肺失清润，故咳嗽喉痒；燥热灼津，则口干鼻燥；燥热伤肺，肺络受损，故痰中带血；身热头痛，伴有少许恶寒，为风燥外客，卫气不和的表现；舌红少津，苔薄黄，脉数，均属燥热之征。治法为疏风清肺，润燥止咳（A对）。